主动脉瓣关闭不全的常见病理表现
A. 粘连
B. 钙化
C. 增厚
D. 卷曲
E. 变硬

正确答案：C。增厚

解析：主动脉瓣关闭不全的病理表现有瓣膜增厚、变硬、卷曲、缩短或瓣膜的破裂和穿孔，也可因腱索增粗，缩短和粘连引起，但前者最常见（C对DE错）。